碘缺乏病的流行特征，不正确的是
A. 山区患病率高于平原
B. 内陆患病率高于沿海
C. 农村患病率高于城市
D. 青春期发病率高
E. 男性多于女性

正确答案：E。男性多于女性

解析：本题考查碘缺乏病的流行特征。碘缺乏病是指从胚胎发育至成人期由于碘摄入量不足而引起的一系列病症。其流行特征是：山区患病率高于平原（A对）；内陆患病率高于沿海（B对）；农村患病率高于城市（C对）；青春期发病率高（D对）；成年人的患病率，女性高于男性（E错，为本题正确答案）。